下丘脑分泌促性腺激素释放激素呈脉冲式，脉冲间隔为
A. 30～60秒
B. 60～90秒
C. 60～90分钟
D. 60～90小时
E. 60～90天

正确答案：C。60～90分钟

解析：下丘脑促性腺激素释放激素的分泌呈脉冲式，脉冲间隔为60～90分钟。生理作用是调节垂体促性腺激素的合成和分泌。掌握“女性生殖系统生理”知识点。